最常见的一类高动力型休克是：
A. 失血失液性休克
B. 创伤性休克
C. 烧伤性休克
D. 感染性休克
E. 心源性休克

正确答案：D。感染性休克

解析：高动力型休克指病原体或其毒素侵入机体后，最常见于感染性休克（D对ABCE错），引起高代谢和高动力循环状态，即出现发热、心排出益增加、外周阻力降低、脉压增大等临床特点，又称为高排低阻型休克或暖休克。